奎尼丁的药理作用的叙述，正确的是
A. 适度抑制Na⁺内流，降低心肌自律性
B. 可使正常窦房结自律性明显降低
C. 竞争性阻断β受体，有抗胆碱作用
D. 可缩短动作电位时程
E. 可加快心脏传导速度

正确答案：A。适度抑制Na⁺内流，降低心肌自律性

解析：奎尼丁的药理作用：①降低自律性：通过阻滞钠通道，适度抑制Na⁺内流，4相自动除极速率减慢，心房肌、心室肌和浦肯野纤维的自律性降低，其中对心房肌的作用更强（A对）。在治疗剂量下对正常窦房结的自律性影响很小（B错），但对病窦综合征患者则明显降低其自律性。②减慢传导速度：适度抑制Na⁺内流，使动作电位0相上升的速率和振幅降低，因而减慢心房肌、心室肌、浦肯野纤维的传导速度（E错）③延长ERP（D错）④其他：奎尼丁有明显的抗胆碱作用，竞争性地阻滞M受体，使心率加快、房室结传导加快；还可阻滞α受体，使外周血管舒张，血压下降而反射性兴奋交感神经（C错）。